腹部闭合性损伤导致下列某一部位破裂时，出现腹膜炎症状最晚的是
A. 结肠
B. 十二指肠球部
C. 胃
D. 回肠
E. 空肠

正确答案：A。结肠

解析：结肠的主要功能是吸收水分和无机盐，不分泌消化液。腹部闭合性损伤致结肠破裂时，由于结肠内容物液体成分少而细菌含量多，故腹膜炎出现得较晚（A对）。十二直肠球部（B错）、胃（C错）、回肠（D错）和空肠（E错）均为腹膜内位器官（表面几乎完全被腹膜所覆盖的器官），而且可以分泌大量的消化液，一旦破裂后，消化液流入腹腔内可刺激腹膜，早期即可出现明显的腹膜刺激症状。